阴虚便秘的特征是
A. 高热，腹满胀痛，舌红苔黄燥
B. 便干，舌红苔少，脉细数
C. 大便秘结，肢冷身凉，脉沉迟
D. 便秘，噫气，胸痞闷，胁胀满
E. 大便数日不通，排便困难，便后疲惫

正确答案：B。便干，舌红苔少，脉细数

解析：大便秘结，排出困难，数日一行，兼口燥咽干，舌红少苔，脉细数者，属阴虚（B对）。高热，腹满胀痛，舌红苔黄燥为阳明腑实证的临床表现（A错）。大便秘结，肢冷身凉，脉沉迟为冷秘表现（C错）。便秘，嗳气，胸痞闷，胁胀满属气秘的临床表现（D错）。大便数日不通，排便困难，便后疲惫为气虚秘（E错）。